经济发展对健康的作用主要表现在
A. 提高居民物质生活水平、增加卫生投资
B. 提高卫生服务水平、改善卫生服务状况
C. 提高居民生活水平、降低营养不良人群比例
D. 提高卫生服务技术水平、增强服务能力
E. 提高卫生资源的使用效率、增强人群健康素质

正确答案：A。提高居民物质生活水平、增加卫生投资

解析：本题考查经济发展对健康的作用。经济发展对健康的作用主要表现在：1.提高居民物质生活水平；2.增加卫生投资（A对BCDE错）；3.通过对教育的影响间接影响人群健康。